虹膜
A. 呈矢状位的圆盘形薄膜
B. 虹膜游离缘肥厚围成瞳孔
C. 虹膜将眼房分为较小的前房和较大的后房
D. 虹膜与巩膜交界处构成前房角
E. 无

正确答案：B。虹膜游离缘肥厚围成瞳孔

解析：虹膜是呈冠状位的的圆盘形薄膜，而非矢状位（A错）。虹膜将眼房分为较大的前房和较小的后房，而非较小的前房和较大的后房（C错）。虹膜角，即前房角，是虹膜与角膜交界处的环形区域，故虹膜与巩膜交界处构成前房角（D错，故B为本题正确答案）错误。